喉平对的颈椎体
A. 第2-4
B. 第3-5
C. 第3-6
D. 第5-6
E. 第5-7

正确答案：C。第3-6

解析：喉平对的第3-6颈椎体（C对）。